化学致癌过程至少分为哪三个阶段
A. 引发（启动），促长，进展
B. 促长，进展，浸润
C. 引发（启动），促长，转移
D. 进展，浸润，炎症
E. 引发（启动），进展，转移

正确答案：A。引发（启动），促长，进展